下列可使醛固酮分泌增多的因素是
A. 血糖浓度增高
B. 血Ca²⁺浓度降低
C. 血K⁺浓度增高
D. 循环血量增多
E. 血Na⁺浓度升高

正确答案：C。血K⁺浓度增高